68岁男性，患高脂血症，在饮食中应避免的食物是
A. 鱼类
B. 豆类
C. 水果
D. 动物脑
E. 乳类

正确答案：D。动物脑